为了解患者肺泡换气功能，给予100％氧，吸入15min,观察吸纯氧前后的PaO₂,如变化不大，属下列何种异常?
A. 功能性分流
B. 解剖性分流
C. 弥散障碍
D. 死腔样通气
E. 通气障碍

正确答案：B。解剖性分流

解析：吸入纯氧可有效地提高功能性分流的PaO₂, 而对解剖性分流（真性分流）的PaO₂则无明显作用，用这种方法可对两者进行鉴别。